男，36岁。因体表烧伤入院，估计深Ⅱ度面积为15%，Ⅲ度面积为25%。患者入院经抗休克治疗，3天来病情好转，其下一步的治疗应是
A. 继续补液抗体克
B. 联合应用抗生素抗感染
C. 创面湿敷，使焦痂脱落
D. 分期切除焦痴，创面植皮
E. 焦痂干固脱落再处理

正确答案：D。分期切除焦痴，创面植皮